让受试者先用力作深吸气，然后以最快的速度尽力呼出气体，分别测量第1、2、3秒末的呼出气量，计算其占肺活量的百分数，分别称为第1、2、3秒的
A. 肺活量
B. 用力肺活量
C. 用力呼气量
D. 深吸气量
E. 最大通气量

正确答案：C。用力呼气量